溴新斯的明的特点有
A. 口服剂量远大于注射剂量
B. 含有酯基，碱水中可水解
C. 注射时使用其甲硫酸盐
D. 属不可逆胆碱酯酶抑制剂
E. 尿液中可检出两个代谢产物

正确答案：A、B、C、E。口服剂量远大于注射剂量；含有酯基，碱水中可水解；注射时使用其甲硫酸盐；尿液中可检出两个代谢产物